舌苔淡黄而滑润者是
A. 邪热盛
B. 湿热盛
C. 食积化热
D. 水饮化热
E. 阳虚水湿

正确答案：D。水饮化热

解析：舌苔淡黄而润滑多津者，称为黄滑苔，多为寒湿、痰饮聚久化热所致（D对）。邪热熏灼于舌，故苔呈黄色。一般情况下，苔色愈黄，说明热邪愈甚，浅黄苔为热轻，深黄苔为热重，焦黄苔为热结（A错）。黄苔而质腻者，主湿热或痰热内蕴，或为食积化腐（BC错）。苔薄白而滑，多为外感寒湿，或脾肾阳虚，水湿内停（E错）。